为提高医务人员对患者识别的准确性，医院管理中强调必须严格执行“三查七对”制度，其中的三查是
A. 开方查、配药查、输液查
B. 门诊查、取药查、发药查
C. 操作前查、操作中查、操作后查
D. 开方查、取药查、发药查
E. 门诊查、住院查、出院查

正确答案：C。操作前查、操作中查、操作后查

解析：根据“三查七对”制度规定，三查是指操作前查、操作中查、操作后查（C对）。七对是指对床号、姓名、药名、剂量、浓度、时间和用法。